外色黑似铁，研粉红似火，火燃呛鼻，有苯甲酸样香气的药材是
A. 阿魏
B. 血竭
C. 没药
D. 乳香
E. 安息香

正确答案：B。血竭

解析：本题考查的是血竭的性状鉴别。外色黑似铁，研粉红似火，火燃呛鼻，有苯甲酸样香气的药材是血竭（B对）。血竭【性状鉴别】饮片为不规则形的小块，长0.5～1cm，表面暗红色至黑红色，微显光泽，手触之易沾染。质坚脆。气微，味淡。或研成细粉，呈红色。本品粉末，置白纸上，用火隔纸烘烤即熔化，但无扩散的油迹，对光照视呈鲜艳的红色。以火燃烧则产生呛鼻的烟气。阿魏（A错）【性状鉴别】呈不规则的块状和脂膏状。颜色深浅不一，表面蜡黄色至棕黄色。块状者体轻，质地似蜡，断面稍有孔隙；新鲜切面颜色较浅，放置后色渐深。腊膏状者黏稠，灰白色。具强烈而持久的蒜样特异臭气，味辛辣，嚼之有灼烧感。没药（C错）【性状鉴别】饮片醋没药：不规则小块状或类圆形颗粒状，表面棕褐色或黑褐色，有光泽。具特异香气，略有醋香气，味苦而微辛。本品粉末乙醚滤液置蒸发皿中挥尽后，残留的黄色液体滴加硝酸，显褐紫色。本品粉末加香草醛试液数滴，天然没药立即显红色，继而变为红紫色；胶质没药立即显紫红色，继而变为蓝紫色。乳香（D错）【性状鉴别】药材呈长卵形滴乳状、类圆形颗粒或黏合成大小不等的不规则块状物。表面黄白色，半透明，被有黄白色粉末，久存则颜色加深。质脆，遇热软化。破碎面有玻璃样或蜡样光泽。具特异香气，味微苦。本品燃烧时显油性，冒黑烟，有香气；加水研磨成白色或黄白色乳状液。安息香（E错）【性状鉴别】球形颗粒压结成的团块，大小不等，外面红棕色至灰棕色，嵌有黄白色及灰白色不透明的杏仁样颗粒，表面粗糙不平坦。